男，70岁，软弱无力，进食减少，口渴、多尿2周，近2天嗜睡。急诊检查：BP70/50mmHg，神志朦胧，皮肤干燥失水，呼吸34次/分，心率108次/分，尿糖（++++），尿酮（±）。既往无糖尿病史。为明确诊断，除血糖测定外，首选的检查是
A. 血电解质+BUN+Cr
B. 糖基化血红蛋白+BUN+Cr
C. 血气分析+BUN+Cr
D. 血酮体+血气分析
E. 血乳酸+血气分析

正确答案：A。血电解质+BUN+Cr

解析：老年男性患者，既往无糖尿病病史（高渗性非酮症糖尿病昏迷的好发人群），近2周出现口渴、多尿、软弱无力、进食减少，近2天嗜睡，查体出现血压下降与脱水表现、意识障碍（高渗性非酮症糖尿病昏迷典型临床表现），化验尿糖强阳性，尿酮体弱阳性，应考虑诊断为高渗性非酮症糖尿病昏迷。高渗性非酮症糖尿病昏迷即高渗高血糖综合征，实验室检查可发现血糖明显升高、由于脱水导致的血浆渗透压升高，血浆渗透压以晶体渗透压为主，可以血液中占主要成分的两种离子：Na⁺、K⁺与血糖浓度来计算血浆渗透压即有效血浆渗透压（mOsm/L）=2×（Na⁺+K⁺）+血糖（均以mmol/L计算）。因此检查血糖与血电解质水平（A对）可有助于确诊高渗高血糖综合征。血BUN、Ccr意义不大。糖基化血红蛋白（B错）反映患者近8～12周平均血糖水平，仅能协助诊断糖尿病，无法诊断高渗高血糖综合征。血气分析（C错）多用于酸碱平衡紊乱的诊断，高渗高血糖综合征一般无酸碱平衡紊乱。血酮体（D错）检查多用于糖尿病酮症酸中毒。血乳酸（E错）检查多用于乳酸酸中毒。